酚的毒作用机制主要是
A. 改变细胞微环境
B. 使蛋白质变性沉淀
C. 影响氧化呼吸链
D. 致突变作用
E. 引起电解质紊乱

正确答案：B。使蛋白质变性沉淀

解析：本题考查酚的毒作用机制。酚在低浓度时能使蛋白质变性，高浓度时则能使蛋白质沉淀（B对ACDE错）。酚对皮肤黏膜有强烈的刺激腐蚀作用，也可抑制中枢神经系统或损害肝肾功能。水体中的酚可经皮肤接触或经饮用由胃肠道吸收。进入机体的酚类化学物在肝脏代谢转化，代谢迅速，代谢产物可与葡萄糖醛酸等结合而毒性降低，随尿液排出。急性酚中毒者主要表现为大量出汗、肺水肿、吞咽困难、肝及造血系统损害、黑尿等。